诊断肾癌最常见的检查方法是
A. 肾穿刺活检
B. IVU
C. KUB
D. CT（平扫+增强）
E. 逆行肾盂造影

正确答案：D。CT（平扫+增强）

解析：CT目前诊断肾癌最可靠的影像学方法（D对）。肾穿刺活检适用于各种类型的肾小球肾炎，肾小球肾病，肾病综合征以及原因不明的持续性无症状蛋白尿和血尿等肾脏疾病的诊断，不是诊断肾癌最常见检查方法（A错）。IVU（排泄性尿路造影或静脉尿路造影）注入造影剂来显示尿路形态，了解分侧肾功能（P516），对肾癌诊断无意义（B错）。KUB（肾输尿管膀胱摄影）常用于尿路结石的检查，不用于肾癌（C错）。逆行肾盂造影用于了解输尿管和肾集合系统功能（P316）（E错）。